手太阴肺经的起始穴是
A. 少商
B. 中府
C. 商阳
D. 迎香
E. 肺俞

正确答案：B。中府

解析：手太阴肺经起于中府穴（B对），止于少商穴。